肛诊检查触及不规则肿物，质硬、固定，最可能是
A. 肛裂
B. 直肠癌
C. 肛瘘
D. 内痔
E. 直肠息肉

正确答案：B。直肠癌

解析：肛诊检查触及不规则肿物，质硬、固定，考虑直肠癌（B对）。肛裂（A错）行肛指检查时，常引起剧烈疼痛，退出可见手套染血。肛瘘（C错）常可扪及条索状物或瘘内口出小硬结。内痔（D错）一般不易扪及，多柔软。直肠息肉（E错）肛指检查扪及质软可推动的圆形肿块。